哌替啶不良反应不包括
A. 出汗
B. 恶心
C. 呕吐
D. 发热
E. 心悸

正确答案：D。发热

解析：本题考查吗啡、哌替啶。哌替啶不良反应不包括发热（D错，为本题正确答案）。治疗量时不良反应与吗啡相似，可致眩晕、出汗（A对）、口干、恶心（B对）、呕吐（C对）、心悸（E对）和直立性低血压等。剂量过大可明显抑制呼吸。偶可致震颤、肌肉痉挛、反射亢进甚至惊厥。久用产生耐受性和依赖性。